患者，男性，22岁。因剧烈运动后，突然出现左胸痛，深吸气时胸痛明显加重，伴有气促。体格检查：气管向右偏移，左胸廓稍膨隆，呼吸音减弱。下列诊断哪项是对的
A. 哮喘
B. 心源性呼吸困难
C. 心绞痛
D. 左侧自发性气胸
E. 以上都不是

正确答案：D。左侧自发性气胸

解析：患者在运动后突然出现胸痛，体格检查表现为气胸，因此正确答案是D。掌握“气胸”知识点。